下述哪一作用是吗啡对中枢神经系统的药理作用
A. 扩瞳
B. 止吐
C. 缩瞳
D. 催眠
E. 麻醉

正确答案：B。止吐